酸价是指
A. 中和1g油脂中游离脂肪酸所需KOH的亳克数
B. 中和1g油脂中游离脂肪酸所需NaOH的毫克数
C. 中和10g油脂中游离脂肪酸所需KOH的毫克数
D. 中和10g油脂中游离脂肪酸所需NaOH的毫克数
E. 中和1g油脂中游离脂肪酸所需KOH的克数

正确答案：A。中和1g油脂中游离脂肪酸所需KOH的亳克数

解析：本题考查酸价。酸价是指中和1g油脂中游离脂肪酸所需氢氧化钾（KOH）的毫克数（A对BCDE错）。